心室肌细胞动作电位2期复极的离子基础是
A. Na⁺内流、K⁺外流
B. K⁺外流、CI⁻内流
C. K⁺外流、Ca²⁺内流
D. Na⁺外流、K⁺内流
E. K⁺内流、Ca²⁺内流

正确答案：C。K⁺外流、Ca²⁺内流